天疱疮的激素治疗特点是
A. 停药后病情一般不复发
B. 强调量大、从速，迅速控制炎症
C. 强调渐进、忌躁，由低量慢慢递加
D. 可以被中药取代，以减少激素的不良反应
E. 可动态地分为起始、控制、减量、维持4个阶段

正确答案：E。可动态地分为起始、控制、减量、维持4个阶段

解析：本题考查天疱疮的激素治疗特点。起始阶段的糖皮质激素的量视病情而定，在旧病损愈合且无新发病损出现的情况下，达到减量的指征，应渐减，以防病情复发，情况稳定予于小剂量激素维持，直至停止药物治疗（E对）。天疱疮激素治疗起始阶段量大、从速（B错），在病情达到减量的指征时，应渐减，否则引起药物依赖性，不利于机体恢复。低量递加（C错）的方式治疗天疱疮病情得不到控制。糖皮质激素对天疱疮明显有效，配合中药可以减轻糖皮质激素的副作用，但不能代替激素治疗（D错）。糖皮质激素治疗往往只能对患者的病情起到很好的抑制作用，而不能彻底治愈该病，停药反弹、愈后复发的现象时有发生（A错）。